仅在体内有抗凝血作用的药物是
A. 肝素
B. 华法林
C. 噻氯匹啶
D. 尿激酶
E. 维生素K

正确答案：B。华法林

解析：本题考查华法林。华法林（B对）属于维生素K拮抗药，仅在体内有抗凝血作用。肝素（A错）在体内体外均有抗凝血作用。噻氯匹啶（C错）是抗血小板药物。尿激酶（D错）是溶栓药，用于血栓栓塞性疾病的溶栓治疗。维生素K（E错）能促进血液凝固。